某外科医师善治疮肿瘰疬、乳腺增生等，常用中成药小金丸（糊丸），用后每能收效。该药处方有人工麝香，木鳖子（去壳去油）、制草乌、枫香脂，醋乳香，醋没药，五灵脂（醋炒）、酒当归、地龙、香墨等，功能散结消肿，化瘀止痛，主治痰气凝滞所致的瘰疬、乳岩、乳癖。症见肌肤或肌肤下肿块一处或数处，推之能动或骨及骨关节肿大，皮色不变、肿硬作痛。关于处方中醋乳香炮制方法或炮制作用的说法，错误的是
A. 每100kg乳香用米醋10kg
B. 醋乳香炮制宜采用文火加热
C. 醋乳香炮制宜先炒乳香至表面微熔再喷入米醋
D. 乳香醋炙后刺激性缓和，利于服用
E. 乳香醋炙后增强活血止痛、消肿生肌的功效

正确答案：A。每100kg乳香用米醋10kg

解析：本题考查的是醋乳香炮制方法和炮制作用。醋乳香炮制时，每100kg乳香，用米醋5kg（A错，为本题正确答案）。醋乳香：取净乳香，置炒制容器内，用文火加热（B对），炒至冒烟，表面微熔，喷淋定量的米醋（C对），边喷边炒至表面油亮光泽时，迅速取出，摊开放凉。每100kg乳香，用米醋5kg。醋乳香刺激性缓和，利于服用（D对），便于粉碎。醋炙乳香还能增强活血止痛、收敛生肌的功效（E对），并可以矫臭矫味。